可以用来提高葡萄糖注射液的澄明度的是
A. 滑石粉
B. 活性炭
C. 两者均采用
D. 两者均不采用

正确答案：B。活性炭

解析：本题考查注射剂常用附加剂。葡萄糖是由淀粉水解制备的，葡萄糖原料中可能带入淀粉中的杂质如蛋白质及淀粉水解不完全的糊精。因此，如葡萄糖原料不纯，葡萄糖输液易产生云雾状沉淀。解决办法一般采用浓配法，加热煮沸使糊精继续水解成为葡萄糖，并加速蛋白质凝固，同时加入适量盐酸中和蛋白质胶粒上的电荷使其凝聚，加入活性炭（B对）吸附，采用滤膜过滤使之除去。滑石粉（ACD错）为片剂中常用的润滑剂。